引起非淋菌性尿道炎最常见的病原体是
A. 解脲支原体
B. 阴道毛滴虫
C. 白色念珠菌
D. 单纯疱疹病毒
E. 沙眼衣原体

正确答案：A。解脲支原体

解析：本题考查常见性传播疾病及其病原体。引起非淋菌性尿道炎最常见的病原体是解脲支原体（A对BCDE错），其还可引起细菌性阴道病等疾病。